个人健康问题记录不包括
A. 问题目录
B. 问题描述
C. 个人基本情况
D. 周期性检查记录
E. 病情流程表

正确答案：D。周期性检查记录

解析：本题考查个人健康问题的记录。个人健康问题的记录包括：问题目录（A对）、问题描述（B对）、个人基本情况（C对）、病情流程表（D对）。周期性检查记录（D错，为本题正确答案）不属于个人健康问题记录。